下列有关抗菌斑附着剂说法不正确的是
A. 阻止菌斑在牙面附着
B. 吸附凝集口腔内细菌
C. 阻止菌斑堆积
D. 不具有解吸附功能
E. 包括茶多酚、甲壳胺

正确答案：D。不具有解吸附功能

解析：本题考查抗菌斑附着剂。下列有关抗菌斑附着剂说法不正确的是不具有解吸附功能（D错，为本题正确答案）。抗菌斑附着剂有解吸附功能。抗菌斑附着剂：包括有茶多酚、甲壳胺等（E对），这些物质除有弱的抑菌作用外，主要作用是阻止菌斑在牙表面附着（A对）。甲壳胺是氨基多糖类物质，有表面阳离子活性，可以吸附凝集口腔内细菌（B对），阻止菌斑堆积（C对），同时也有解吸附功能，使已附着牙面的菌斑脱落。一些无机离子如：氟、锌、镧有明显抗附着作用。